输精管始端续于
A. 精曲小管
B. 睾丸输出管
C. 睾丸网
D. 精直小管
E. 附睾尾

正确答案：E。附睾尾

解析：附睾尾（E对）延续为输精管的始端。